在匹配病例对照研究时，为了节约样本，提高效率，常用1：M配比，但M的取值一般
A. ＜2
B. ＜3
C. ≤4
D. ＜5
E. ＜6

正确答案：C。≤4

解析：本题考查病例对照研究的匹配比例。在匹配病例对照研究中，总样本量一定时，如果病例和对照的来源都较充足，病例与对照之比为1:1时的统计学效率最高。为了节约样本，提高效率，常用1：M配比，但M的取值一般不超过4（C对ABDE错）。